男医师给女患者进行妇科检查时需有护士或其他医务人员在场的规定遵循的伦理要求是
A. 耐心倾听，正确引导
B. 对症下药，剂量安全
C. 严谨求实，防止差错
D. 尊重患者，心正无私
E. 尊重患者，知情同意

正确答案：D。尊重患者，心正无私

解析：男医师给女患者进行妇科检查时需有护士或其他医务人员在场的规定遵循的伦理要求是尊重患者，心正无私（D对）。